发挥转运作用的是
A. mRNA
B. rRNA
C. 核糖体
D. miRNA
E. tRNA

正确答案：E。tRNA

解析：本题考查RNA。发挥转运作用的是tRNA（E对）。RNA一般是DNA的转录产物。（1）编码RNA是指mRNA（A错），它是细胞质中蛋白质合成的模板。真核细胞核中的hnRNA经过一系列的修饰后成为成熟的mRNA。真核成熟mRNA含有5´-帽结构、编码区和3´多聚（A）尾结构。mRNA编码区中的每3个核苷酸构成了一个密码子，决定了新生多肽链上的一个氨基酸。（2）非编码RNA主要有tRNA、rRNA和一些参与RNA剪接和修饰的小RNA。①tRNA在蛋白质合成过程中作为氨基酸的载体，为新生多肽链提供合成底物。mRNA密码子与tRNA的反密码子通过碱基互补关系相互识别。②rRNA（B错）与核糖体蛋白共同构成了核糖体，核糖体（C错）是蛋白质合成的场所。核糖体为mRNA、tRNA和肽链合成所需要的多种蛋白质因子提供结合位点和相互作用所需要的空间环境。③其他非编码RNA包括snRNA、snoRNA、scRNA、miRNA（D错）、lncRNA等，它们的主要生物学功能是参与基因表达调控。